不参与Ⅰ型超敏反应的介质或细胞因子是
A. 组胺
B. LTs
C. PAF
D. PGD₂
E. IFN-γ

正确答案：E。IFN-γ